与肝相表里的是
A. 胆
B. 胃
C. 小肠
D. 大肠
E. 膀胱

正确答案：A。胆

解析：肝和胆通过经脉相互络属构成了表里关系（A对）。脾与胃（B错）构成了相表里的关系。心与小肠（C错）相表里。肺与大肠（D错）相表里。肾与膀胱（E错）相表里。